雌激素禁用于
A. 青光眼患者
B. 高钙血症
C. 高磷血症
D. 乳腺癌
E. 高脂血症

正确答案：D。乳腺癌

解析：本题考查雌激素的禁忌症。雌激素禁用于乳腺癌（D对）。长期使用雌激素，发生乳腺癌的几率增大。青光眼（A错）是指眼内压间断或持续升高的一种眼病。高钙血症（B错）是指血清离子钙浓度的异常升高。成人血磷值超过1.61mmol/L（正常成人血磷浓度为0.97～1.61mmol/L）即为高磷血症（C错）。血浆中一种或多种脂质高于正常称为高脂血症（E错），以上四种均不是雌激素的禁忌症。